正常成人腋测法体温应是
A. 36～37℃
B. 36.2～37℃
C. 36.2～37.2℃
D. 36.4～37.4℃
E. 36.5～37.5℃

正确答案：A。36～37℃

解析：体温测量方式分为腋测法、口测法及肛测法。腋测法是指将体温计头端置于患者腋窝深处，嘱患者用上臂将体温计夹紧，10分钟后读数，正常值为36～37℃（A对）。口测法是指将消毒后的体温计头端置于患者舌下，让其紧闭口唇，5分钟后读数，正常值为36.3～37.2℃。肛测法是指让患者取侧卧位，将肛门体温计头端涂以润滑剂后，徐徐插入肛门内达体温计长度的一半为止，5分钟后读数，正常值为36.5～37.7℃。